某男，30岁。感冒后咳嗽，服用安嗽糖浆，因其含有西药成分盐酸麻黄碱，避免重复用药，不宜与安嗽糖浆同时服用的中成药有
A. 消痰咳片
B. 消咳宁片
C. 镇咳宁糖浆
D. 良园枇杷叶膏
E. 化痰平喘片

正确答案：B、C、D。消咳宁片；镇咳宁糖浆；良园枇杷叶膏

解析：本题考查的是含西药组分的中成药。某男，30岁。感冒后咳嗽，服用安嗽糖浆，因其含有西药成分盐酸麻黄碱，避免重复用药，不宜与安嗽糖浆同时服用的中成药有消咳宁片（B对）、镇咳宁糖浆（C对）、良园枇杷叶膏（D对）。消咳宁片：功能止咳祛痰。用于感冒、咳嗽、气管炎、支气管哮喘等。含西药成分盐酸麻黄碱、碳酸钙。镇咳宁糖浆：功能止咳，平喘，祛痰。用于风寒束肺所致的咳嗽、气喘、咳痰；支气管炎、支气管哮喘见上述证候者。含西药成分盐酸麻黄碱。良园枇杷叶膏：清热化痰，宣肺止咳。用于外感风热、肺气失宣所致的风热咳嗽，症见发热、咳嗽、痰黄、气促。含西药成分盐酸麻黄碱。消痰咳片（A错）：功能清热祛痰，止咳平喘。用于急慢性支气管炎的痰热证之咳嗽，痰黄难咳，或兼喘息之证候。含西药成分盐酸依普拉酮、甲氧苄啶、磺胺林。化痰平喘片（E错）：功能清热化痰，止咳平喘。用于急慢性支气管炎、肺气肿、咳嗽痰多、胸满气喘。含西药成分盐酸异丙嗪。